《中国药典》中，苦参的质量控制成分是
A. 麻黄碱
B. 小檗碱
C. 氧化苦参碱
D. 乌头碱
E. 番木鳖碱

正确答案：C。氧化苦参碱

解析：本题考查中药的化学成分。《中国药典》中，苦参的质量控制成分是氧化苦参碱（C对）。苦参所含主要生物碱是苦参碱和氧化苦参碱，《中国药典》以其为指标成分对苦参进行鉴别和含量测定，含量测定要求苦参碱和氧化苦参碱总量不得少于1.2%。麻黄中含有多种生物碱，以麻黄碱（A错）和伪麻黄碱为主，前者占总生物碱的40%～90%，《中国药典》以盐酸麻黄碱和盐酸伪麻黄碱为指标成为对麻黄进行含量测定，要求药材和饮片含盐酸麻黄碱和盐酸伪麻黄碱的总量不得少于0.80%。黄连的有效成分主要是生物碱，已经分离出来的生物碱有小檗碱（B错）、巴马汀等。《中国药典》以小檗碱为指标成分对黄连进行含量测定。乌头和附子主要含二萜类生物碱，属于四环或五环二萜类衍生物。据报道，从各种乌头中分离出的生物碱已达400多种。乌头生物碱的结构复杂、结构类型多。其重要和含量较高的有乌头碱（D错）、次乌头碱和新乌头碱。《中国药典》以三者为指标成分对川乌进行含量测定。马钱子成熟种子中生物碱含量为1.5%～5%，主要生物碱是土的宁（又称番木鳖碱（E错））、马钱子碱及其氮氧化物，还含少量的10余种其他吲哚类生物碱，其中以士的宁含量居首，占总碱量的35%～50%，其次是马钱子碱，占总碱量的30%～40%。《中国药典》以士的宁和马钱子碱为指标成分对马钱子进行含量测定。